下列选项中属于现代人口再生产类型特征的是
A. 高出生率、高死亡率、高自然增长率
B. 高出生率、高死亡率、低自然增长率
C. 低出生率、低死亡率、低自然增长率
D. 低出生率、高死亡率、低自然增长率
E. 高出生率、低死亡率、高自然增长率

正确答案：C。低出生率、低死亡率、低自然增长率

解析：本题考查现代人口再生产类型特征。低出生率、低死亡率、低增长率（C对ABDE错）的“三低”模式属于现代人口再生产类型特征。